根尖手术中哪种翻瓣术的优点是不破坏边缘龈，易于切开，术野清楚
A. 扇形瓣
B. 矩形瓣
C. 不规则形瓣
D. 半圆形瓣
E. 半月形瓣

正确答案：A。扇形瓣

解析：扇形瓣：又称Ochsenbein-Luebke瓣。优点是不破坏边缘龈和牙龈附着，易于切开和翻起，术野清楚。掌握“根尖手术”知识点。